女性，55岁。丧偶8年，现独居，嗜烟酒，不爱运动。平时性情抑郁，过分容忍，办事无主见，常顺从于别人。1月前行胃癌切除，术中及术后情绪低落，兴趣下降，常独自流泪，有轻生之念。病人术后的情绪反应属于
A. 焦虑
B. 抑郁
C. 恐惧
D. 痛苦
E. 内疚

正确答案：B。抑郁